正态分布曲线下横轴上，从-∞到μ+1.96σ的区间面积占总面积的
A. 90%
B. 95%
C. 97.5%
D. 99%
E. 99.5%

正确答案：C。97.5%

解析：正态分布曲线下面积分布有一定的规律：①曲线下的面积即为概率；②曲线下的总面积为1或100%，以μ为中心左右两侧面积各占50%，越接近μ处曲线下面积越大，两边逐渐减少；③所有正态曲线，在μ左右的任意一个标准差范围内面积相同，如区间μ±1.96σ范围内的面积约为95.00%。可知1.96σ到+∞的区间面积占总面积的2.5%，P（-∞，μ+1.96σ）=1-P（1.96σ，+∞）=1-0.025=0.975，因此从-∞到μ+1.96σ的区间面积占总面积的97.50%（C对）。